在队列研究中
A. 不能计算相对危险度
B. 不能计算归因危险度
C. 只能计算比值比
D. 既可计算相对危险度又可计算归因危险度

正确答案：D。既可计算相对危险度又可计算归因危险度

解析：本题考查队列研究的优点。队列研究的最大优点就在于它可以直接计算出研究对象的结局的发生率，因而也就能够直接计算出RR和AR（D对ABC错），从而可直接评价暴露的效应。